引起中药不良反应的主要原因有
A. 个体差异
B. 配伍不当
C. 剂型失宜
D. 辨证不准
E. 离经悖法

正确答案：A、B、C、D、E。个体差异；配伍不当；剂型失宜；辨证不准；离经悖法

解析：本题考查的是引起中药不良反应的主要原因。引起中药不良反应的主要原因有个体差异（A对）、配伍不当（B对）、剂型失宜（C对）、辨证不准（D对）与离经悖法（E对）。引起中药不良反应的主要原因，主要有以下几点：（1）品种混乱；（2）误服毒药；（3）用量过大；（4）炮制失度；（5）剂型失宜；（6）疗程过长；（7）配伍不当；（8）管理不善；（9）辨证不准；（10）个体差异；（11）离经悖法。